仅发生于小儿的眼病是
A. 视力低下
B. 近视
C. 远视
D. 散光
E. 弱视

正确答案：E。弱视